关于单室静脉滴注给药的错误表述是
A. k₀是零级滴注速度
B. 稳态血药浓度Css与滴注速度k₀成正比
C. 稳态时体内药量或血药浓度恒定不变
D. 欲滴注达稳态浓度的99%，需滴注3.32个半衰期
E. 静滴前同时静注一个k₀／k的负荷剂量，可使血药浓度一开始就达稳态

正确答案：D。欲滴注达稳态浓度的99%，需滴注3.32个半衰期

解析：本题考查单室模型静脉滴注给药。静脉滴注给药达到稳态血药浓度的百分数与半衰期之间的关系式为：n=-3.32lg（1-fss），代入99%即可求得半衰期为6.64个（D错，为本题正确答案）；C=k₀（1-e-kt）／kV，式中：k₀为零级滴注速度（A对）；稳态血药浓度Css=k₀/kV，与k₀成正比（B对）；稳态时体内血药浓度恒定（C对）；滴注前静注一个负荷剂量，使血药浓度迅速达到或接近Css（E对）。